女性，36岁。突然寒战高热，腰痛并尿急、尿痛1周，既往无类似病史，检查：体温39度，右侧肾区叩击痛阳性，尿蛋白（+），白细胞20～30个/HP，白细胞管型0～2个/低倍，比重1.022。诊断的主要依据是
A. 突然寒战高热
B. 腰痛
C. 尿急、尿痛
D. 右侧肾区叩击痛（+）
E. 尿蛋白（+），白细胞20～30个/HP，白细胞管型0～2个/低倍

正确答案：E。尿蛋白（+），白细胞20～30个/HP，白细胞管型0～2个/低倍

解析：该患者诊断为急性肾盂肾炎的主要依据是尿蛋白（+），白细胞20～30个/HP，白细胞管型0～2个/低倍（E对）。突然寒战高热（A错）可见于多种感染性疾病；腰痛（B错）和右侧肾区叩击痛（+）（D错）可见于肾盂肾炎、肾结石及肾周围炎等多种疾病；尿频尿痛（C错）可见于多种尿路感染的疾病。因此ABCD都不是最佳选择。